新生儿寒冷损伤综合征寒凝血滞证治疗首选方剂是
A. 四逆汤
B. 参附汤
C. 金匮肾气丸
D. 当归四逆汤
E. 血府逐瘀汤

正确答案：D。当归四逆汤

解析：新生儿寒冷损伤综合征寒凝血滞证多系体弱小儿中寒而致，治宜温经散寒、活血通络，治疗首选方为当归四逆汤加减（D对）。参附汤为新生儿寒冷损伤综合征阳气虚弱证的首选方剂（B错）。